患者，女，21岁。手背部有5〜6枚，表面光滑的扁平丘疹，如针头到米粒大，呈淡褐色，偶有瘙痒感。其诊断是
A. 传染性软疣
B. 寻常疣
C. 掌跖疣
D. 丝状疣
E. 扁平疣

正确答案：E。扁平疣

解析：本题考查疣的诊断鉴别。传染性软疣多见于儿童，皮损为半球形丘疹，米粒到黄豆、豌豆大小，中央有脐凹，表面有蜡样光泽，挑破顶端儿可挤压出白色乳酪样物质，数目不定，数个到数十个不等，呈散在性或簇集性分布，但不相融合，好发于躯干和面部，题中病例为光滑的扁平丘疹，如针头到米粒大，呈淡褐色（A错）。寻常疣多发于儿童及青年，最初为一个针头大至绿豆大的疣状赘生物，呈半球形或多角形，突出表面，色灰白或污黄，表面蓬松枯槁，状如花蕊，粗糙而坚硬，以后体积渐次增大，发展成乳头状赘生物，好发于手背、手指，也可见于头面部，题中丘疹为扁平状而非半球形或多角形，为灰褐色而非灰白或污黄色（B错）。掌跖疣发生在手掌、足底或指（趾）间，皮损为角化性丘疹，中央凹陷，外周有稍带黄色高起的角质环，除去表面角质后，或见疏松的白色乳头状角质物，数目多时可融合成片，题中发于手背，无角质环（C错）。丝状疣多发生于颈项或眼睑部位，皮损为单个细软的丝状突起，呈褐色或淡红色，可自行脱落，不久又可长出新的皮损，一般无自觉症状，题中发于手背，非细软的丝状突起（D错）。扁平疣多发于青年男女，皮损为表面光滑的扁平丘疹，针头、米粒到黄豆大小，呈淡红色、褐色或正常皮肤颜色，好发于颜面部和手背。一般无自觉症状，偶有瘙痒感，与题中患者症状相符（E对）。